患者，男性，35岁。上唇部肿胀疼痛3天，伴发热症状，肿胀的唇部皮肤与黏膜上出现多数的黄白色脓头，破溃后溢出脓血样分泌物，病变区呈紫红色，体温38.5℃。此部分感染最常见的致病菌为
A. 大肠杆菌
B. 溶血性链球菌
C. 变形性链球菌
D. 铜绿假单胞菌
E. 金黄色葡萄球菌

正确答案：E。金黄色葡萄球菌

解析：本题考查面部疖痈。面部疖痈是一种急性化脓性炎症，最常见的致病菌是金黄色葡萄球菌（E对）。